凝胶剂常用的保湿剂是
A. 卡波姆
B. 乙醇
C. 丙二醇
D. 羟苯乙酯
E. 聚山梨酯

正确答案：C。丙二醇

解析：本题考查凝胶剂的保湿剂。水性凝胶一般由水、甘油或丙二醇与纤维素衍生物、卡波姆和海藻酸盐等高分子材料构成，丙二醇（C对）作为凝胶的保湿剂。